在差示扫描量热法的分析过程中
A. 样品的质量与参比物质的质量相同
B. 样品的温度与参比物质的温度相同
C. 样品吸收的热量与参比物质吸收的热量相同
D. 样品的熔点与参比物质的熔点相同
E. 不需要参比物质

正确答案：B。样品的温度与参比物质的温度相同